阴阳学说认为，机体健康时，阴阳之间的关系为
A. 阴阳转化
B. 阴阳对立
C. 阴阳消长
D. 阴平阳秘
E. 阴阳互根

正确答案：D。阴平阳秘

解析：阴与阳相互对抗、相互制约和相互排斥，以求其统一，取得阴阳之间的相对的动态平衡，称之为“阴平阳秘”（D对）；阴阳转化，是指相互对立的阴阳双方，在一定条件下可各自向其对立面转化。阴阳转化，属于质变过程中事物从化到变的运动规律（A错）；阴阳对立是阴阳双方的互相排斥、互相斗争（B错）；阴阳消长，是指对立互根的阴阳双方的量和比例不是一成不变的，而是处于不断的增长或消减的运动变化之中（C错）；阴阳互根，是指相互对立的阴阳双方，又相互依存、相互化生、相互为用、相互吸引地共处于一个统一体中（E错）。